患者男，60岁。3年前患急性广泛性前壁心肌梗死，现又见持续性剧烈胸痛，甚则心痛彻背，背彻痛心，形寒肢冷，神疲气怯，伴心悸气短，手足青紫厥冷，舌紫暗苔滑润，脉沉细。其治法是
A. 温阳泻肺，活血利水
B. 益气温阳，化瘀通络
C. 益气养阴，化瘀通络
D. 益气温阳，行痹散寒
E. 滋阴逐饮，化瘀通络

正确答案：D。益气温阳，行痹散寒

解析：本题患者为心肌梗死，寒邪侵犯人体，寒凝胸中，心阳不振，鼓动乏力，则心悸气短；阳气亏虚，形体失于温煦，则形寒肢冷；心神失养，则神疲气怯；心阳虚衰，寒凝经脉，心脉痹阻不通，则剧烈胸痛，手足青紫。伴见畏寒肢冷，舌紫暗苔滑润，脉沉细等为寒凝心脉之象，所以宜益气温阳，行痹散寒（D对）；温阳泻肺，活血利水用于痰饮阻肺证，症见喘咳气急，张口抬肩，不能平卧，痰多色白或黄稠，心悸烦躁，胸闷脘痞，面青汗出，口唇紫绀，舌质紫暗，舌苔厚腻或白或黄，脉弦滑而数（A错）；益气温阳，化瘀通络用于心肾阳虚证，症见心悸而痛，胸闷气短，动则更甚，自汗，面色苍白，神倦怯寒，四肢欠温，四肢肿胀，舌质淡胖，边有齿痕，苔白或腻，脉沉细而迟（B错）；益气养阴，化瘀通络用于气阴两虚证，症见心胸隐痛，时作时止，心悸气短，动则益甚，伴倦怠乏力，声低气微，面色㿠白，易于汗出，舌淡红，舌体胖且边有齿痕，脉细缓或结代（C错）；滋阴逐饮，化瘀通络主治冠心病气阴两虚证，症见偶有胸闷憋气，或心前区不定时隐痛，时而在睡眠中憋醒，心慌气短，全身乏力，腰部、下肢浮肿，面色苍白，质淡胖或紫暗，苔水滑，脉细数无力，时有结脉、代脉（E错）。